稽留流产
A. 易引起DIC
B. 易引起失血性休克
C. 易引起颈管粘连
D. 易引起迷走神经综合征
E. 最易致肠管损伤

正确答案：A。易引起DIC

解析：稽留时间过长，会释放凝血活酶进入母血循环，激活血管内凝血因子，引起DIC。掌握“自然流产”知识点。